用于治疗前列腺癌的药物是
A. 争光霉素
B. 马利兰
C. 放线菌素D（更生霉素）
D. 环磷酰胺
E. 雌激素

正确答案：E。雌激素

解析：本题考查雌激素。雌激素（E对）抑制黄体生成素释放激素的分泌，抑制雄激素活性，直接抑制睾丸细胞的功能以及对前列腺细胞的直接毒性，可用于前列腺癌。争光霉素（A错）可用于治疗皮肤恶性肿瘤、头颈部肿瘤、肺癌、食管癌、恶性淋巴瘤等。马利兰（B错）适用于慢性粒细胞白血病慢性期的缓解治疗。放线菌素D（C错）用于肾母细胞瘤、绒毛膜上皮癌、横纹肌肉瘤和神经母细胞瘤等。环磷酰胺（D错）用于治疗恶性淋巴瘤、急性或慢性淋巴细胞白血病、多发性骨髓瘤等。